患者，诊断为三叉神经痛，定分支检查为第Ⅲ支，“扳机点”在右下后磨牙区相对的颊黏膜处；口内检查，右下后磨牙均已拔除；X线检查，拔牙区相应的下颌骨内可见界限清楚的散在透光区。此患者首选的治疗方法是
A. 病变骨腔清除术
B. 下牙槽神经切断撕脱术
C. 颏孔无水乙醇注射法
D. 理疗
E. 半月神经节射频温控热凝术

正确答案：A。病变骨腔清除术

解析：本题考查三叉神经痛首选的治疗方法。根据题干X线检查可知右下下颌骨内有病变，首先考虑此病变引起的下颌支神经痛，因此此患者首选的治疗方法是病变骨腔清除术（A对）。若术后神经痛症状消失则说明下颌支神经痛是由病变骨腔引起的，若未消失则可根据病情采用药物、下牙槽神经切断撕脱术（B错）、颏孔无水乙醇注射法（C错）、理疗（D错）、半月神经节射频温控热凝术（E错）等方法继续治疗。